补中益气丸既能补中益气，又能
A. 健脾养心
B. 升阳举陷
C. 疏肝和胃
D. 益气健脾
E. 温补气血

正确答案：B。升阳举陷

解析：本题考查的是补中益气丸的功能。补中益气丸既能补中益气，又能升阳举陷（B对）。补中益气丸：【功能】补中益气，升阳举陷。刺五加：【功效】补气健脾，益肾强腰，养心（A错）安神，活血通络。小柴胡颗粒：【功能】解表散热，疏肝和胃（C错）。香砂六君丸：【功能】益气健脾（D错），和胃。人参养荣丸：【功能】温补气血（E错）。